描述性研究主要适用于
A. 病因研究
B. 疾病分布调查
C. 预防效果研究
D. 疾病危险因素研究
E. 疾病自然史研究

正确答案：B。疾病分布调查

解析：本题考查描述性研究的用途。描述性研究的用途包括：1.描述疾病或者健康状况的分布（B对ACDE错）及发生发展的规律；2.获得病因线索，提出病因假设。